冠脉血流的特点不正确的叙述是
A. 在安静状态下，人冠脉血流量为每百克心肌每分钟60-80ml
B. 占心输出量的4%～5%
C. 冠脉血流量的多少主要取决于循环血量
D. 摄氧率高
E. 周期供血，波动大

正确答案：C。冠脉血流量的多少主要取决于循环血量